乳糜池在哪个椎体的前方
A. T11
B. T12
C. L1
D. L2
E. L3

正确答案：C。L1

解析：乳糜池是人体淋巴循环的一部分，收集肠干，左右腰干的淋巴，注入到胸导管中，再注入左静脉角，汇入血液中，位于L1（C对）的前面，由左、右腰干和肠干汇合而成。